某女，25岁。产后5天，发热血淋。宜选用的药是
A. 银柴胡
B. 胡黄连
C. 白薇
D. 牡丹皮
E. 地骨皮

正确答案：C。白薇

解析：本题考查的是白薇的主治病证。产后5天，发热血淋。宜选用的药是白薇（C对）。白薇：【主治病证】（1）阴虚发热，骨蒸潮热，产后虚热，阴虚外感。（2）温病热入营血证，肺热咳嗽。（3）热淋，血淋。（4）痈肿疮毒，咽喉肿痛，毒蛇咬伤。银柴胡（A错）：【主治病证】（1）阴虚发热，骨蒸劳热。（2）小儿疳热。胡黄连（B错）：【主治病证】（1）骨蒸潮热。（2）小儿疳热。（3）湿热泻痢，黄疸。（4）咽痛，疮肿，痔肿便血。牡丹皮（D错）：【主治病证】（1）温病热入血分而发斑疹，血热吐血、衄血。（2）温病后期阴虚发热，久病伤阴之无汗骨蒸。（3）血滞之闭经、痛经，产后瘀阻，癥瘕，跌打伤肿。（4）痈肿疮毒，肠痈腹痛。地骨皮（E错）：【主治病证】（1）阴虚发热，有汗骨蒸，小儿疳热。（2）血热之吐血、衄血、尿血。（3）肺热咳嗽。（4）内热消渴。